调剂室工作人员收集患者ADR信息的目的不是
A. 为防止药害事件重演
B. 为评价药品提供依据
C. 为追究药品生产企业的责任
D. 为保障患者用药安全
E. 为临床用药提供信息

正确答案：C。为追究药品生产企业的责任

解析：本题考查药品不良反应。调剂室工作人员收集患者ADR信息的目的不是为追究药品生产企业的责任（C错，为本题正确答案）。药品不良反应（ADR）是指合格药品在正常用法用量下出现的与用药目的无关的有害反应，药品上市后仍需随时进行不良反应监测，主要目的在于：1．弥补药品上市前研究的不足，为评价药品提供依据（B对）。2．减少ADR的危害，通过监测可及时发现重大药害事件，防止药害事件的蔓延和扩大（A对），保障患者安全用药（D对）。3．促进新药的研制开发。4．促进临床合理用药（E对）。